患者，女，21岁。两小腿皮炎，在亚急性阶段，渗液与糜烂很少，红肿减轻，有鳞屑和结痂。外治剂宜选用
A. 洗剂
B. 粉剂
C. 溶液湿敷
D. 软膏
E. 油剂

正确答案：E。油剂

解析：本题考查外用药物的剂型的适应症。油剂具有润泽保护、解毒收敛、止痒生肌的作用。适用于亚急性皮肤病中有糜烂、渗出、鳞屑、脓疱、结痂、溃疡的皮损，本患者渗液与糜烂少，有鳞屑和结痂，当选油剂（E对）。洗剂有清凉止痒、保护、干燥、消斑解毒之功。适用于无渗液性的急性或亚急性的皮炎类皮肤病（A错）。粉剂具有保护、吸收、蒸发、干燥、止痒的作用。适用于无渗液性的急性或亚急性的皮炎类皮肤病（B错）。皮肤炎症在急性阶段，若仅有红斑、丘疹、水疱而无渗液，宜用洗剂、粉剂、乳剂。若有大量渗液或明显红肿，则用溶液湿敷为宜（C错）。皮肤炎症在慢性阶段，有浸润肥厚、角化过度时，则用软膏为主（D错）。